常见前纵隔肿瘤是
A. 畸胎瘤与皮样囊肿
B. 神经源性肿瘤
C. 肉瘤
D. 平滑肌瘤
E. 支气管囊肿

正确答案：A。畸胎瘤与皮样囊肿

解析：临床上以胸骨角与第四胸椎下缘的水平线为界，将纵隔分为上、下两部。下纵隔再以心包前后界分为前、中、后三部分。前纵隔常见的肿瘤是畸胎瘤与皮样囊肿（A对）。神经源性肿瘤（B错）、支气管囊肿（E错）多位于后纵隔。纵隔部位的肉瘤（C错）、平滑肌瘤（D错）较少见。